下列哪个不属于脑干内的特殊内脏运动核
A. 三叉神经运动核
B. 面神经核
C. 疑核
D. 孤束核
E. 无

正确答案：D。孤束核

解析：特殊内脏运动核包括三叉神经运动核（A对）、面神经核（B对）、疑核（C对）和副神经核。而孤束核（D错，为本题正确答案）为一般内脏感觉核。